缺碘所致甲状腺肿的机制是
A. 甲状腺对碘的浓集能力下降
B. 妨碍酪氨酸的氧化，使甲状腺素合成减少
C. 促使碘从甲状腺中排出增加
D. 影响甲状腺激素的合成，使血浆甲状腺激素水平下降
E. 抑制甲状腺对碘的吸收利用能力，使甲状腺素合成减少

正确答案：D。影响甲状腺激素的合成，使血浆甲状腺激素水平下降

解析：本题考查缺碘所致甲状腺肿的机制。碘缺乏是引起地方性甲状腺肿流行的主要原因，缺碘可影响甲状腺激素的合成，使血浆甲状腺激素水平降低（D对ABCE错），甲状腺发生代偿性增大。